在解剖学上居于诸间隙中心位置的是
A. 咬肌间隙感染
B. 眶下间隙感染
C. 下颌下间隙感染
D. 翼下颌间隙感染
E. 颞下间隙感染

正确答案：E。颞下间隙感染

解析：解剖学基础知识掌握。掌握“翼下颌间隙、颞下间隙感染”知识点。